属于中枢性降压药的是
A. 盐酸普萘洛尔
B. 氯贝丁酯
C. 硝苯地平
D. 甲基多巴
E. 卡托普利

正确答案：D。甲基多巴

解析：本题考查中枢性降压药。属于中枢性降压药的是甲基多巴（D对）。中枢降压药有甲基多巴、可乐定、利美尼定、莫索尼定等。其中甲基多巴通过激动孤束核α₂肾上腺素受体产生降压作用。盐酸普萘洛尔（A错）为β受体阻断药。氯贝丁酯（B错）为调血脂药。硝苯地平（C错）为二氢吡啶类钙通道阻滞剂。卡托普利（E错）为血管紧张素Ⅰ转化酶抑制剂。